属于软膏剂保湿剂的是
A. 十八醇
B. 月桂醇硫酸钠
C. 司盘80
D. 甘油
E. 羟苯乙酯

正确答案：D。甘油

解析：本题考查软膏剂的基质与附加剂。甘油（D对）为软膏剂的保湿剂。软膏剂指药物与适宜基质均匀混合制成的具有一定稠度的半固体外用制剂，常用基质分为油脂性、水溶性和乳剂型基质。十八醇（A错）为软膏剂的油相基质；月桂醇硫酸钠（B错）、司盘80（C错）均为乳化剂；羟苯乙酯（E错）为软膏剂的防腐剂。